促进心肌间质重构的重要因素
A. 肾素-血管紧张素-醛固酮系统激活
B. 交感神经强烈兴奋
C. ADH大量分泌
D. 肿瘤坏死因子作用
E. 白介素大量分泌

正确答案：A。肾素-血管紧张素-醛固酮系统激活

解析：慢性心衰时，心脏通过心室重塑进行代偿，心室重塑包括心肌细胞重构和心肌间质重构。促进心肌间质重构的重要因素是肾素-血管紧张素-醛固酮系统激活（A对），产生增加的血管紧张素Ⅱ（AngⅡ）和醛固酮均可促进非心肌细胞活化或增殖，使其分泌大量不同类型的胶原等细胞外基质，同时又合成降解胶原的间质胶原酶和明胶酶等。通过对胶原合成与降解的调控，促进心肌间质重构。